属于倍半萜类化合物的是
A. 葛根素
B. 莪术醇
C. 芦丁
D. 紫杉醇
E. 薄荷醇

正确答案：B。莪术醇

解析：本题考查的是萜类化合物的分类。属于倍半萜类化合物的是莪术醇（B对）。萜类化合物是一类由甲戊二羟酸衍生而成，基本碳架多具有2个或2个以上异戊二烯单位（C5单位）结构特征的不同饱和程度的衍生物。按照分子中异戊二烯单位的数目可将萜类化合物分为单萜、倍半萜、二萜、二倍半萜、三萜、四萜及多萜。1.单萜：单萜是指基本碳架由2分子异戊二烯单位构成，含有10个碳原子的萜烯及其衍生物。单萜类化合物是挥发油的主要组成成分之一（单萜苷类不具随水蒸气蒸馏的性质），常存在于菊科、唇形科、樟科、桃金娘科、芸香科、伞形科、姜科、松科等植物的腺体、油室及树脂道等分泌组织内。昆虫和微生物的代谢产物以及海洋生物中也含有单萜。单萜类化合物有玫瑰油、香叶天竺葵油、柠檬草油和香茅油等中的香叶醇（牻牛儿醇）；薄荷中的薄荷醇（E错）；冰片中的龙脑等。2.环烯醚萜类：环烯醚萜类为臭蚁二醛的缩醛衍生物，属单萜类化合物。环烯醚萜类化合物在中药中分布较广，特别是在玄参科、茜草科、唇形科及龙胆科中较为常见。环烯醚萜类化合物具有广泛的生物活性，如具有保肝、利胆、降血糖、降血脂、抗炎等作用。环烯醚萜类化合物有栀子中的栀子苷、京尼平苷、京尼平苷酸；鸡屎藤中的鸡屎藤苷；地黄中的梓醇、梓苷；龙胆中的龙胆苦苷；獐牙菜中的獐牙菜苷及獐牙菜苦苷等。3.倍半萜：倍半萜类是由3个异戊二烯单位构成的天然萜类化合物。倍半萜及其含氧化合物多与单萜类共存于植物挥发油中，是挥发油高沸程（250℃～280℃）的主要组分，也有低沸点的固体。在植物界中多以醇、酮、内酯或苷的形式存在。如香茅草、橙花、玫瑰等中金合欢醇（法尼醇）；青蒿（黄花蒿）中的青蒿素；马桑毒素；羟基马桑毒素；莪术中的莪术醇等。4.二萜：是指骨架由4个异戊二烯单位构成，含20个碳原子的一类萜类衍生物。绝大多数不能随水蒸气蒸馏。二萜多以树脂、内酯或苷等形式广泛存在于自然界。不少二萜含氧衍生物具有很好的生物活性，如穿心莲内酯、芫花酯、雷公藤内酯、银杏内酯、紫杉醇（D错）等。葛根素（A错）为葛根的主要化学成分，属于黄酮类化合物。葛根含异黄酮类化合物，主要成分有大豆素、大豆苷、大豆素-7，4'-二葡萄糖苷及葛根素、葛根素-7-木糖苷。《中国药典》以葛根素为指标成分进行含量测定，要求含葛根素不得少于2.4%。芦丁（C错）为槐花的主要化学成分，属于黄酮类化合物。槐花中主要成分及其化学结构：槐米含有芦丁，槲皮素，皂苷，白桦脂醇，槐二醇以及槐米甲、乙、丙素和黏液质等。其中，芦丁是有效成分。槐米中芦丁的含量高达23.5%，槐花开放后降至13.0%。《中国药典》以总黄酮和芦丁为指标成分对槐米或槐花进行含量测定。要求槐花总黄酮（以芦丁计）不少于8.0%，槐米总黄酮不少于20.0%，对照品采用芦丁；要求芦丁含量，槐花不得少于6.0%，槐米不得少于15.0%。